儿童病人的求医行为属
A. 主动型
B. 被动型
C. 强制型
D. 参与型
E. 合作型

正确答案：B。被动型